足月儿出生后3天出现黄疸，母血AB型，第4天血清胆红素171μmol/L。最可能的诊断是
A. BO溶血病
B. Rh溶血病
C. 生理性黄疸
D. 败血症
E. 胆道闭锁

正确答案：C。生理性黄疸

解析：约50%－60%的足月儿可出现生理性黄疸，其特点为：1.一般情况良好；2.足月儿生后2～3天出现黄疸，4～5天达高峰，5～7天消退，最长不超过2周。该患儿血清胆红素＜221μmol/L，为生理性黄疸（C对）。ABO型贫血（P116）常出现在O型血母亲与A或B型血婴儿，该患儿母血AB型（A错）。